6个月女婴，发热3天，体温39℃，查体：一般情况良好，咽充血，耳后淋巴结肿大，心肺无异常，肝脾未触及。若患儿热退后，伴皮疹出现，可能的诊断是
A. 风疹
B. 麻疹
C. 水痘
D. 猩红热
E. 幼儿急疹

正确答案：E。幼儿急疹

解析：6个月女婴，发热3天，体温39℃，查体发现咽充血，耳后淋巴结肿大，心肺无异常，肝脾未触及等符合幼儿急疹的全身症状表现，如：主要见于婴幼儿，一般情况好，耳后淋巴结可肿大等，且该患儿热退后伴皮疹出现符合幼儿急疹发热与皮疹的关系，故该患儿可能的诊断是幼儿急疹（E对）。而风疹（A错）全身症状轻，耳后、枕后淋巴结肿大并触痛，皮疹多在症状出现后1-2天出现，且有面颈部→躯干→四肢的先后顺序，故该患儿不考虑此病。麻疹（B错）的全身症状有发热、咳嗽、畏光、鼻卡他、结膜炎等，皮疹多在发热后3-4天出现，且出疹期为发热的高峰期，为红色斑丘疹，退疹后有色素沉着及细小脱屑，故该患儿不考虑此病。水痘（P174）（C错）出疹前可有前驱症状，如发热、不适和厌食等。24-48小时出疹，皮疹常首发于头、面和躯干，继而扩展到四肢，呈向心性分布，故该患儿不考虑此病。猩红热（D错）的全身症状主要有发热、咽痛、头痛、呕吐、杨梅舌、环扣苍白圈、颈部淋巴结肿大等，皮疹多在发热1-2天出现，且出疹时高热，皮肤弥漫性充血，疹退后伴脱皮，故该患儿不考虑此病。